有关小腿三头肌,不正确的是
A. 包括腓肠肌和比目鱼肌
B. 跖屈踝关节
C. 以跟腱止于跟骨结节
D. 提足跟
E. 受腓深神经支配

正确答案：E。受腓深神经支配

解析：小腿三头肌包括腓肠肌和比目鱼肌（A对），以跟腱止于跟骨结节（C对），屈踝关节和膝关节，即跖屈踝关节（B对）和提足跟（D对），受胫神经支配，而非腓深神经（E错，为本题正确答案）。